外侧丘系纤维
A. 完全交叉至对侧
B. 上行至上丘核
C. 传导头面部的本体感觉
D. 发自下橄榄核
E. 传导双侧听觉

正确答案：E。传导双侧听觉

解析：外侧丘系纤维发自双侧蜗神经核（D错），一侧外侧丘系纤维包括大部分由对侧蜗神经核发出并交叉至同侧的纤维和少部分由同侧蜗神经核发出并未交叉的纤维（A错）。外侧丘系上行进入下丘，大部分纤维止于下丘核（B错），少部分纤维继续上行止于后丘脑的内侧膝状体并换元。内侧膝状体发出纤维组成听辐射投射至大脑皮质颞横回的听觉中枢，因一侧外侧丘系纤维包含双侧蜗神经核发出的纤维，故其传导双侧听觉（E对C错）。